患者上颌牙完全缺失，双侧上颌结节过度增生，修复前应当
A. 局部按摩
B. 观察，局部不进行处理
C. 舌系带延长术
D. 上颌结节修整术
E. 牙槽突修整术

正确答案：D。上颌结节修整术

解析：上颌结节，结节过度增生形成较大的骨性倒凹。对双侧上颌结节肥大的情况，常常只需修整一侧上颌结节，解决妨碍义齿就位的问题即可。掌握“牙槽外科”知识点。